通过分解产生新生态氧而发挥杀菌除臭作用，用于治疗痤疮的药物是
A. 维A酸
B. 过氧苯甲酰
C. 壬二酸
D. 阿达帕林
E. 异维A酸

正确答案：B。过氧苯甲酰

解析：本题考查痤疮治疗药的作用特点。通过分解产生新生态氧而发挥杀菌除臭作用，用于治疗痤疮的药物是过氧苯甲酰（B对）。过氧苯甲酰为强氧化剂，极易分解，遇有机物分解出新生态氧而发挥杀菌除臭作用，可杀灭痤疮丙酸杆菌，并可使皮肤干燥和脱屑。维A酸（A错）是维生素A的代谢中间体，可调节表皮细胞的有丝分裂和表皮的细胞更新，使病变皮肤的增生和分化恢复正常，促进毛囊上皮的更新，抑制角蛋白的合成，防止角质栓的形成。壬二酸（C错）可直接抑制和杀灭皮肤表面和毛囊内的细菌，消除病原体，对皮肤上的各种需氧菌和厌氧菌包括痤疮丙酸杆菌和表皮葡萄球菌具有抑制和杀灭作用。阿达帕林（D错）是维A酸类化合物，与维A酸细胞核受体有较高的亲和力，具有强大抗炎作用。可抑制外周血液中多形白细胞的化学趋化，并通过抑制花生四烯酸经脂氧化反应转化为炎症介质白三烯，抑制多核型白细胞的代谢，缓解由细胞介导的炎性反应，抑制角质形成细胞过度增生，溶解痤疮和粉刺。异维A酸（E错）是维A酸的光学异构体，具有缩小皮脂腺，抑制皮脂腺活性，减少皮脂分泌，以及减轻上皮细胞分化和减少毛囊中痤疮丙酸杆菌的作用。